男，15岁，2个月无意中发现右小腿近端肿物，无疼痛及活动障碍，查体：右小腿近端可触及约3cm×2cm肿物，质地较硬，无活动，无明压痛，X线检查见右胫骨干骺端有蒂的骨性突起，无骨质破坏及骨反应，最适宜的处理方法为
A. 中药外敷
B. 切开取病理
C. 随诊观察
D. 穿刺活检
E. 手术切除

正确答案：C。随诊观察

解析：青少年男性患者，无意中发现小腿近端肿物，X线检查见右胫骨干骺端有蒂的骨性突起，无骨质破坏及骨反应，说明为良性肿瘤，符合骨软骨瘤的诊断，治疗上随诊观察（C对）即可。中药外敷（A错）适用于开放性骨折的治疗。切开取病理（B错）、穿刺活检（D错）、手术切除（E错）适用于恶性肿瘤或良性肿瘤恶性病变时。